某男，其行为表现为做事动作快，总想在尽可能短的时间内完成尽可能多的工作，说话大声并具暴发性，喜欢竞争，对人怀有潜在的敌意和戒心，常常不耐烦和敌意。该男子较别人更容易得
A. 冠心病
B. 糖尿病
C. 关节炎
D. 耳聋
E. 胃癌

正确答案：A。冠心病